胸片后前位两侧肺野透亮度减低，可见大小相等密度一致分布均匀的小结节状阴影应考虑的疾病是
A. 支气管肺炎
B. 过敏性肺炎
C. 浸润性肺结核
D. 粟粒性肺结核
E. 肺水肿

正确答案：D。粟粒性肺结核

解析：急性粟粒性肺结核X线表现为两肺弥漫性粟粒状阴影。粟粒大小为1～2mm，边缘清晰。粟粒影像特点主要为三均匀，即分布、大小和密度（D对）。支气管肺炎X 线表现：病变常见于两肺下野的中内带，表现为沿增粗的肺纹理有散在的多数密度不均匀、边界模糊的小斑片状致密阴影，亦可融合成片状或云絮状密度增高的阴影，但密度不均匀（A错）。过敏性肺炎X线示弥漫性粟粒状影多不均匀，常伴有小斑状实变影（B错）。浸润性肺结核X线表现多种多样，可以1种为主或多种征象混合并存。增殖性病变呈斑点状阴影。结核球呈圆形、椭圆形阴影，边缘清晰，轮廓光滑，偶有分叶，密度较高，内部常见斑点、层状或环状钙化；结核球周围常见散在的纤维增殖性病灶，称为“卫星灶”。结核性空洞为圆形或椭圆形病灶内见透亮区，空洞壁薄，内壁一般较规则，有时可呈厚壁不规则空洞（C错）。间质性肺水肿的特征性表现为肺纹理增多变粗，模糊不清，肺野透光度低而模糊，肺小叶间隔增宽，形成KerleyB线。肺泡水肿主要表现为腺泡状增密阴影，相互融合呈不规则片状模糊阴影，弥漫分布，由肺门两侧向外伸展，逐渐变淡，形成典型的蝴蝶状阴影。有时两肺中下野出现不对称的大片阴影，与炎症不易区别（E错）。